参与瞳孔对光反射的结构
A. 黑质
B. 红核
C. 顶盖前区
D. 上丘
E. 无

正确答案：C。顶盖前区

解析：顶盖前区（C对）发出纤维经后连合或中脑导水管腹侧至双侧动眼神经副核换元，完成瞳孔对光反射和晶状体调节反射；黑质（A错）主要与多巴胺相关疾病有关；红核（B错）主要兴奋屈肌运动神经元，同时抑制伸肌运动神经元；上丘（D错）主要参与头、 颈部的视觉和听觉的躯体反射活动。